患者，女，25岁。停经3个月，阴道淋漓流血2个月，阴道前壁有胡桃大紫蓝色结节，子宫软，如孕4个月大小，尿妊娠试验阳性。应考虑为
A. 葡萄胎
B. 侵蚀性葡萄胎
C. 双胎妊娠
D. 妊娠合并子宫肌瘤
E. 先兆流产

正确答案：B。侵蚀性葡萄胎

解析：患者为年轻女性，停经3个月（怀疑早孕），阴道淋漓流血2个月（疑为葡萄胎或妊娠滋养细胞肿瘤），查体：阴道前壁有胡桃大紫蓝色结节（阴道转移征象，转移灶常位于阴道前壁及穹窿，呈紫蓝色结节），子宫软，如孕4个半月大小（子宫异常增大），尿妊娠试验阳性，应首先考虑妊娠滋养细胞肿瘤-侵蚀性葡萄胎（B对）。葡萄胎（P336）（A错）为良性病变，与侵蚀性葡萄糖临床症状相似，但不会发生阴道转移。先兆流产（P48）（E错）指妊娠28周前先出现少量阴道流血，随后出现阵发性下腹痛或腰背痛。妇检：子宫大小与停经周数相符，无阴道转移征象。双胎妊娠（P122）（C错）、妊娠合并子宫肌瘤（P313）（D错）妊娠早期均不会出现阴道淋漓流血及阴道转移征象。